蝶筛隐窝位于
A. 上鼻甲前上方
B. 上鼻甲下方
C. 蝶骨上方
D. 上鼻甲的后上方与蝶骨之间
E. 无

正确答案：D。上鼻甲的后上方与蝶骨之间

解析：蝶筛隐窝位于上鼻甲的后上方与蝶骨之间（D对）。